可引起牙龈废用性萎缩的是
A. 牙冠轴面无突度
B. 牙冠轴面突度过大
C. 牙冠（牙合）面副沟排溢道不明显
D. 牙冠（牙合）外展隙不明显
E. 牙冠轴面突度过小

正确答案：B。牙冠轴面突度过大

解析：本题考查牙冠唇（颊）、舌面突度的生理意义。可引起牙龈废用性萎缩的是牙冠轴面突度过大（B对）。咀嚼时，排溢的食物顺着正常的牙冠突度滑至口腔，经过牙龈表面时对牙龈起到生理性按摩作用，可促进牙龈的血液循环，有利于牙龈组织的健康。若牙冠突度过小（E错）或无突度（A错），牙龈将会受到食物的直接撞击而受伤；若牙冠突度过大，牙龈会失去食物对其的按摩作用，可能产生失用性萎缩。